医学模式转变对医师提出的根本性医德要求是
A. 学习伦理学
B. 学习生命价值论
C. 学习公益论
D. 更加注重处于社会关系中的，作为一个整体的病人的人文方面
E. 注重改变传统的医学道德观念

正确答案：D。更加注重处于社会关系中的，作为一个整体的病人的人文方面

解析：生物-心理-社会医学模式对医德提出了更高的要求。不仅要关心病人的躯体，而且要关心病人的心理；不仅要关心病人的个体，而且要关心病人的家属、后代及整个社会。生物-心理-社会医学模式认为：人的心理与生理、精神与躯体、机体的内外环境是一个完整的统一体，心理、社会因素与疾病的发生、发展和转归关系密切。医学模式的转变，要求医生心身并重，对病人的躯体和心理进行综合诊治，因此对医师提出的根本性医德要求是更加注重处于社会关系中的，作为一个整体的病人的人文方面（D对）。